6个月以内婴儿无热性支气管肺炎应考虑诊断为
A. 葡萄球菌肺炎
B. 合胞病毒性肺炎
C. 革兰阴性杆菌肺炎
D. 肺炎支原体肺炎
E. 衣原体肺炎

正确答案：E。衣原体肺炎

解析：衣原体肺炎分为沙眼衣原体、肺炎衣原体、鹦鹉热衣原体和家畜衣原体，而沙眼衣原体肺炎常发生于6月内的婴儿（E对），可于产时或产后感染，症状为无热或低热、鼻塞、气促、咳嗽。葡萄球菌肺炎常见于1岁以下的婴儿，在出现1～2天上呼吸道感染或皮肤小脓疱数日至1周以后，突然出现寒战、高热，年长儿大多有弛张性高热（A错），新生儿表现为呼吸和心率增快、呻吟、咳嗽、青紫等，可有黄脓痰或脓血痰。合胞病毒性肺炎其中半数以上为1岁以内婴儿，男多于女，主要症状为发热（B错）、咳嗽、喘息、气促，中、重症有较明显的呼吸困难、喘憋、口唇青紫、鼻煽及三凹征。革兰阴性杆菌肺炎任何年龄均可发病，表现为起病急骤，寒战、高热（C错），肺水肿和呼吸衰竭，呼吸道症状多有胸痛、咳嗽。肺炎支原体肺炎多见于年长儿（D错），发热、咳嗽、咯痰为主要症状。